化学毒物对不同个体毒作用敏感性不同，其原因不包括
A. 化学物的化学结构和理化性质
B. 代谢酶的遗传多态性
C. 机体修复能力差异
D. 宿主其他因素

正确答案：A。化学物的化学结构和理化性质

解析：本题考查化学毒物对不同个体毒作用敏感性不同的原因。化学毒物对不同个体毒作用的敏感性不同，其原因包括：代谢酶的遗传多态性（B对）；机体修复能力差异（C对）；宿主其他因素（D对）等。化学物的化学结构和理化性质（A错，为本题正确答案）不是化学毒物对不同个体毒作用敏感性不同的原因。